增强子的作用特点是
A. 只作用于真核细胞中
B. 有固定的部位，必须在启动子上游
C. 有严格的专一性
D. 无需与蛋白质因子结合就能增强转录作用
E. 作用无方向性

正确答案：E。作用无方向性

解析：增强子的作用特点：①能（通过启动子）提高同一条链上的靶基因转录速率；②增强子对同源基因或异源基因同样有效；③增强子的位置可在基因5’-上游、基因内或3’下游序列中；④自身没有5’-或3’-方向性；⑤增强子可远离转录起始点（最多30Kb）；⑥增强子一般具有组织或细胞特异性作用无方向性。掌握“基因表达调控原理”知识点。